男，31岁。因低热咳嗽痰中带血1月余，诊断左上肺肺结核，现正规抗结核治疗（2HRZE/4HR）已4个月，近1周来纳差，肝功能检查示ALT较正常升高4倍。此时应采取的最佳措施是
A. 加用护肝药
B. 停抗结核药物
C. 改用HE+链霉素
D. 改用HE+对氨基水杨酸
E. 改用HE+左氧氟沙星

正确答案：B。停抗结核药物

解析：患者诊断左上肺肺结核，应用正规抗结核药物治疗（2HRZE/4HR），治疗方案中异烟肼、利福平和吡嗪酰胺都会造成肝功能损害，而本患者应用此方案4个月后，已出现纳差和转氨酶升高，表明患者肝功能损害较重，因此应立刻停药（ALT高于正常值上限3倍则需停药），等待肝功能恢复正常（B对）。护肝药可以作为补充治疗，但不是最佳措施（A错）。异烟肼可造成肝功能损害，可加重患者症状，如果不是必须治疗的肺结核的话不应继续采用，对氨基水杨酸以及左氧氟沙星也可造成肝功能损害（P71），故这三种药物通常在肝功能严重损害的情况下不应采用（CDE错）。